药品安全性指标不包括
A. “三致”
B. 毒性
C. 疗效
D. 配伍、使用禁忌
E. 药物相互作用

正确答案：C。疗效

解析：本题考查药品安全性指标。药品安全性指标不包括药品的疗效（C错，为本题正确答案）。药品的安全性是指按规定的适应症和用法、用量使用药品后，人体产生毒副反应的程度。药品安全性指标包括：药品的“三致”（A对）、毒性（B对）、不良反应和副作用、药物相互作用（E对）和配伍、使用禁忌（D对）等。其中“三致”指的是致畸、致癌、致突变。